观察吸烟与肺癌关系的研究结果表明，250个肺癌患者中吸烟者150人，250个非肺癌病人中吸烟者50人，通过这些数据可以计算
A. 人群归因危险度
B. 特异危险度
C. 相对危险度
D. 比值比
E. 人群归因危险度百分比

正确答案：D。比值比